髁突在位于下颌窝的最上、最中位置的是
A. 后退接触位
B. 侧颌颌位
C. 下颌姿势位
D. 前伸（牙合）颌位
E. 牙尖交错位

正确答案：A。后退接触位

解析：本题考查颌位。髁突在位于下颌窝的最上、最中位置的是后退接触位（A对）。RCP为后退接触位又称正中关系位（CRP），在此位置时，双侧髁突处于正中关系位，是生理性后位；解剖位置是髁突位于关节窝中的前一上位；此位表明下颌的后方功能范围。